某男5岁。近患肺热咳嗽，血热衄血。宜选用的药是
A. 银柴胡
B. 胡黄连
C. 白薇
D. 牡丹皮
E. 地骨皮

正确答案：E。地骨皮

解析：本题考查的是地骨皮的主治病证。某男5岁。近患肺热咳嗽，血热衄血。宜选用的药是地骨皮（E对）。地骨皮：【主治病证】（1）阴虚发热，有汗骨蒸，小儿疳热。（2）血热之吐血、衄血、尿血。（3）肺热咳嗽。（4）内热消渴。银柴胡（A错）：【主治病证】（1）阴虚发热，骨蒸劳热。（2）小儿疳热。胡黄连（B错）：【主治病证】（1）骨蒸潮热。（2）小儿疳热。（3）湿热泻痢，黄疸。（4）咽痛，疮肿，痔肿便血。白薇（C错）：【主治病证】（1）阴虚发热，骨蒸潮热，产后虚热，阴虚外感。（2）温病热入营血证，肺热咳嗽。（3）热淋，血淋。（4）痈肿疮毒，咽喉肿痛，毒蛇咬伤。牡丹皮（D错）：【主治病证】（1）温病热入血分而发斑疹，血热吐血、衄血。（2）温病后期阴虚发热，久病伤阴之无汗骨蒸。（3）血滞之闭经、痛经，产后瘀阻，癥瘕，跌打伤肿。（4）痈肿疮毒，肠痈腹痛。